女，27岁。妊娠38周，伴头痛、头晕、视物不清1天。体格检查BP180/110mmHg，尿蛋白（+），浮肿（+），胎心140次/分。肛诊子宫颈管未消失。NST为无反应型，最恰当的处理是
A. 静脉滴注硫酸镁，继续妊娠
B. 降压利尿
C. 治疗4天无好转行剖宫产术
D. 促宫颈成熟
E. 治疗同时立即剖宫产

正确答案：E。治疗同时立即剖宫产

解析：该患者妊娠38周（孕37～42周为足月产），头痛头晕视物不清（重度子痫前期可有持续头痛或视觉障碍或其它脑神经症状），BP180/110mmHg（重度子痫前期收缩压≥160mmHg和（或）舒张压≥110mmHg），尿蛋白（+）（子痫前期尿蛋白阳性），浮肿，无抽搐（抽搐是子痫区别于子痫前期的特征性临床症状），应诊断为重度子痫前期。无应激试验（NST）指在无宫缩、无外界负荷刺激下，对胎儿进行胎心率宫缩图的观察和记录，以了解胎儿储备能力。该实验为无反应型，说明胎儿储备能力低，需及时终止妊娠，子宫颈管未消失，提示宫颈管未成熟，不能短时间内进行阴道分娩，故治疗同时立即剖宫产（E对）。